肠结核最常见的发病部位是
A. 直肠
B. 乙状结肠
C. 回盲部
D. 回肠末段
E. 升结肠

正确答案：C。回盲部

解析：肠结核最常见的发病部位是回盲部（C对）。直肠（A错）和乙状结肠（B错）是细菌性痢疾（P359）最常见的发病部位。回肠末端（D错）是肠伤寒（P358）最常见的发病部位。升结肠（E错）和盲肠是肠阿米巴病（P369）最常见的发病部位。